临床工作的道德特点
A. 发挥医务人员主导性的同时，关注疾病，注意与病人沟通，调动患者的主体性
B. 与患者的沟通比关注疾病本身更重要
C. 注重患者的主诉是诊断疾病的主要条件
D. 维护患者利益，但患者利益要先服从社会效益
E. 开展躯体疾病服务的同时，还要注重经济效益和社会效益

正确答案：A。发挥医务人员主导性的同时，关注疾病，注意与病人沟通，调动患者的主体性